检查病员咬合关系是否正常、有无紊乱。属于以上哪项
A. 外形与关节动度检查
B. 咀嚼肌检查
C. 颈前三角检查
D. （牙合）关系检查
E. 下颌运动检查

正确答案：D。（牙合）关系检查

解析：（牙合）关系检查：检查病员咬合关系是否正常、有无紊乱；覆（牙合）覆盖程度及（牙合）曲线是否正常；（牙合）磨耗情况是否均匀一致，程度如何。此外，还应检查牙齿情况，龋病、牙周病、牙缺失和牙倾斜、移位等，以助关节疾病的诊断和治疗。掌握“口外一般检查及辅助检查”知识点。